十滴水，处方：樟脑25g、干姜25g、大黄20g、小茴香10g、肉桂10g、辣椒5g、桉油12.5ml。制法：以上七味，除樟脑和桉油外。其余干姜等五味粉碎成粗粉，混匀，用70%乙醇作溶剂，浸渍24小时后进行渗漉，收集渗漉液约750ml，加入樟脑和桉油，搅拌使完全溶解，再继续收集渗漉液至1000ml，搅匀，即得。根据处方及其制法判断，该制剂属于
A. 浸膏剂
B. 合剂
C. 酊剂
D. 酒剂
E. 流浸膏剂

正确答案：C。酊剂

解析：本题考查的是酊剂的特点。十滴水，处方：樟脑25g、干姜25g、大黄20g、小茴香10g、肉桂10g、辣椒5g、桉油12.5ml。制法：以上七味，除樟脑和桉油外。其余干姜等五味粉碎成粗粉，混匀，用70%乙醇作溶剂，浸渍24小时后进行渗漉，收集渗漉液约750ml，加入樟脑和桉油，搅拌使完全溶解，再继续收集渗漉液至1000ml，搅匀，即得。根据处方及其制法判断，该制剂属于酊剂（C对）。酊剂系指原料药物用规定浓度的乙醇提取或溶解而制成的澄清液体制剂，也可用流浸膏稀释制成。浸膏剂（A错）与流浸膏剂（E错）：系指饮片用适宜的溶剂提取，蒸去部分或全部溶剂，调整至规定浓度而制成的制剂。合剂（B错）：系指中药饮片用水或其他溶剂，采用适宜的方法提取、制成的口服液体制剂，其中单剂量灌装者也可称为口服液。酒剂（D错）：系指中药饮片用蒸馏酒提取制成的澄清液体制剂。